胎盘早剥最常见的并发症是
A. DIC
B. 急性肾衰竭
C. 产后出血
D. 席汉综合征
E. 心衰

正确答案：A。DIC

解析：胎盘早剥最常见的并发症是DIC（A对）。